脏腑气滞病变多发生于
A. 肺脾胃肾
B. 心脾胃肝
C. 肝脾胃肾
D. 肺脾胃肝
E. 肝胆肺肾

正确答案：D。肺脾胃肝

解析：脏腑在全身气机中起着极其重要的作用，肝脾宜升，肺胃宜降，故脏腑气滞多以肺、肝、脾胃为多见（D对ABCE错）。